女，24岁。近2个月来四肢关节疼痛，伴皮肤结节、红斑。10天前发热（T38℃）咳嗽，咳少量痰。胸部X线片示右上肺斑片状影伴空洞形成。该患者最可能的诊断是
A. 支气管肺癌
B. 细菌性肺炎
C. 肺囊肿继发感染
D. 肺脓肿
E. 肺结核

正确答案：E。肺结核

解析：患者为青年女性，有发热、咳嗽、咳痰，胸部X线片示右上肺斑片状影伴空洞形成（为肺结核的典型胸片改变），根据其临床表现和辅助检查，怀疑肺结核或其他肺部感染。少数肺结核患者可以有类似风湿热样表现，多见于青少年女性，常累及四肢大关节，在受累关节附近可见结节性红斑或环形红斑，该患者2个月来四肢关节疼痛，伴皮肤结节红斑，符合此特殊表现，因此最可能的诊断为肺结核（E对）。支气管肺癌（P78）（A错）多有长期吸烟史，表现为刺激性呛咳，痰中带血，胸痛和消瘦等，胸部X线或CT表现肺癌肿块常呈分叶状，有毛刺、切迹，癌组织坏死液化后，可以形成偏心厚壁空洞。细菌性肺炎（P46）（B错）大都有上呼吸道感染等前驱症状，与此病情不符。肺脓肿（P58）（D错）多有高热，咳大量脓臭痰，胸片表现为带有液平面的空洞伴周围浓密的炎性阴影。肺囊肿继发感染（C错）不会有关节疼痛、皮肤结节、红斑。